下列那一项不属于心功能不全的病因
A. 心肌炎
B. 严重贫血
C. 过度体力活动
D. 心肌缺血
E. 甲亢

正确答案：C。过度体力活动

解析：心功能不全的病因可分为：心肌收缩性降低、心室负荷过重和心室舒张及充盈受限。心肌炎（A错）可引起心肌细胞发生变性、坏死，导致心肌收缩性降低。心肌缺血（D错）可引起心肌细胞能量代谢障碍，久之会导致舒缩功能降低。长期严重贫血（B错）、甲亢（E错）可引起外周血管阻力降低，使回心血量增加，进而引起心室容量负荷（心肌收缩前承受的负荷）增加，超过心肌代偿能力时会导致心肌舒缩功能降低。过度体力活动（C对）不属于心功能不全的病因。